左向右分流型先天性心脏病最常见的并发症是
A. 细菌性心内膜炎
B. 脑血栓
C. 脑脓肿
D. 肺炎
E. 心力衰竭

正确答案：D。肺炎

解析：成人左向右分流型先天性心脏病有房间隔缺损、室间隔缺损、动脉导管未闭（P274）。先天性心脏病发生左向右分流时，由于肺循环血量增多，肺部血液淤积，使病原体易于生长而引起肺炎（D对）。细菌性心内膜炎（A错）、脑血栓（B错）、脑脓肿（C错）均可继发于左向右分流型先天性心脏病，但较肺炎发生率低。心力衰竭（E错）为疾病晚期并发症，随着现代手术治疗的普及，临床已经少见。